风心病二尖瓣狭窄病人经常出现呼吸困难、咳嗽和咯血等症状，随病程延长，上述症状减轻，但出现腹胀、肝大，提示
A. 二尖瓣狭窄程度减轻
B. 发生二尖瓣关闭不全
C. 合并主动脉瓣狭窄
D. 合并主动脉瓣关闭不全
E. 进入右心功能不全期

正确答案：E。进入右心功能不全期

解析：风心病二尖瓣狭窄病人经常出现呼吸困难、咳嗽和咯血等症状，主要由左心衰竭引起，随病程延长，当进入右心功能不全期（E对）时，右心排出量减少致肺循环血量减少，肺淤血减轻，呼吸困难、咳嗽和咯血等症状也随之减轻，此时会出现右心衰症状如水肿、腹胀肝淤血肿大等。风心病二尖瓣狭窄程度减轻（A错）可出现呼吸困难、咳嗽和咯血等症状减轻，但不会出现腹胀、肝大等右心衰竭症状。发生二尖瓣关闭不全（B错）时左心室收缩期的血液可反流至左心房，使左心房压升高，加重肺淤血，上诉症状会进一步加重而不是减轻。合并主动脉瓣狭窄（C错）时左心室射血受阻，左心室舒张末压升高；合并主动脉瓣关闭不全时（D错）主动脉内的血流可反流回左心室，左心室舒张末压也升高，此时肺循环血液回流入左心室发生障碍，导致肺淤血加重，呼吸困难、咳嗽和咯血等症状应该也加重而不是减轻。